制作油炸类糕点时，煎炸油最高温度不得超过
A. 150℃
B. 250℃
C. 300℃
D. 350℃
E. 400℃

正确答案：B。250℃

解析：本题考查制作油炸类糕点时，煎炸油的最高温度。制作油炸类糕点时，煎炸油最高温度不得超过250℃（B对ACDE错）。